医疗机构应当于校验期满前几个月向登记机关申请办理校验手续
A. 1
B. 2
C. 3
D. 4
E. 5

正确答案：C。3